下列不属于酮症酸中毒补液方法的是
A. 血钾正常、尿量少于30ml/h，应立即补钾
B. 首先补充0.9%氯化钠注射液
C. 当血糖下降至13.9mmol/L时可开始应用含糖的液体，如5%葡萄糖注射液
D. 补钾应根据血钾和尿量
E. 治疗过程中定时监测血钾和尿量

正确答案：A。血钾正常、尿量少于30ml/h，应立即补钾

解析：糖尿病酮症酸中毒的治疗：1.补液 恢复血容量为治疗的关键环节，必须立即进行。输液量和速度的掌握非常重要。在治疗开始应快速补充生理盐水（B对），入无心功能不全，在前2小时内输入1000-2000mL液体，以后根据血压、心率、尿量及末梢循环情况，决定补液量和速度。2.胰岛素治疗 采用小剂量（短效）胰岛素治疗方案，即0.1U/（kg·h）持续静脉滴注（应另建输液途径）。每1-2小时查血糖1次，当血糖下降至13.9mmol/L（250mg/dL）时改用5%葡萄液（C对），并按每2-4g葡萄糖加入1单位短效胰岛素静脉滴注，时血糖水平稳定在较安全范围后过度到常规皮下注射。3.纠正酸碱平衡失调 中等度以下的酸中毒不必补碱，因使用胰岛素后抑制酮体产生，酸中毒即可逐渐纠正。4.充分补钾 治疗前血钾低，立即开始补钾，开始2-4小时通过静脉输液每小时补氯化钾1-1.5g；血钾正常，尿量>40mL/h，也立即开始补钾；血钾正常、尿量<30mL/h，暂缓补钾（A的描述错误，故答案选A），待尿量增加后再开始补钾；血钾高于正常，暂缓补钾。氯化钾部分稀释后静脉输入，部分口服。治疗过程中定时监测血钾、心电图和尿量（E对），调整补钾量和速度。病情恢复后仍应口服钾盐数天。